9岁，学生。1日前因突起高热、剧烈头痛、恶心伴非喷射性呕吐1次入院。体检：神清，全身皮肤散在淤点、淤斑，颈项抵抗。心率120次/分，两肺无异常，腹软无压痛。化验检查：血白细胞计数20×10⁹/L，中性粒细胞89%。淋巴细胞5%，单核细胞6%。最可能的诊断是
A. 伤寒
B. 流行性脑脊髓膜炎
C. 结核性脑膜炎
D. 流行性乙型脑炎
E. 病毒性脑炎

正确答案：B。流行性脑脊髓膜炎